下列不是吸毒的三级预防措施于三级预防的是
A. 戒毒治疗
B. 康复治疗
C. 重返社会
D. 高危人群的预防
E. 善后照顾

正确答案：D。高危人群的预防

解析：本题考查吸毒的三级预防。吸毒的三级预防措施中的三级预防是降低危害，对于难以戒除毒瘾的个体，用替代治疗、针具交换等措施，降低吸毒对个人和社会的危害（ABCE对）。高危人群的预防（D错，为本题正确答案）不属于吸毒的三级预防措施中的三级预防。